心悸心血瘀阻证的特点是
A. 心悸烦躁，善惊痰多
B. 心悸善惊，坐卧不安
C. 惊悸眩晕，胸闷喘憋
D. 心悸怵惕，心痛胸闷
E. 虚烦而悸，耳鸣腰痠

正确答案：D。心悸怵惕，心痛胸闷

解析：心主血脉，心脉瘀阻，心失所养，故心悸怵惕；心脉挛急，故心痛；血瘀气滞，心阳被遏，故胸闷（D对）。心悸烦躁，善惊痰多，属于心悸之痰火扰心证的特点（A错）。心悸善惊，坐卧不安，属于心悸之心虚胆怯证的特点(B错)。惊悸眩晕，胸闷喘憋，属于心悸之水饮凌心证的特点（C错）。虚烦而悸，耳鸣腰痠，属于心悸之阴虚火旺证的特点（E错）。